根据痰饮的致病特点，其所致的病症有
A. 头目眩晕
B. 阴疽流注
C. 身体痛重
D. 癥积痞块
E. 癫狂痴呆

正确答案：A、B、E。头目眩晕；阴疽流注；癫狂痴呆

解析：本题考查的是痰饮的致病特点。根据痰饮的致病特点，其所致的病症有头目眩晕（A对）、阴疽流注（B对）与癫狂痴呆（E对）。痰饮的致病特点：（1）阻滞气血运行：痰饮为实邪，可随气流行全身，或停滞于经脉，或留滞于脏腑，阻滞气机，妨碍气血运行。若痰饮流注于经络，则致经络气机阻滞，气血运行不畅，出现肢体麻木，屈伸不利，甚至半身不遂，或形成瘰疬痰核，阴疽流注等；若痰饮留滞于脏腑，则阻滞脏腑气机，使脏腑气机升降失常。如痰饮阻肺，肺气失于宣降，则见胸闷气喘，咳嗽吐痰等；痰饮停胃，胃气失于和降，则见恶心呕吐等；痰浊痹阻心脉，血气运行不畅，可见胸闷心痛；无形之痰气结滞于咽喉，则形成“梅核气”，临床常见咽中梗阻如有异物，咽之不下，吐之不出，胸膈满闷，情绪低落，善太息等。（2）影响水液代谢：痰饮本为水液代谢失常产生的病理产物，但是痰饮一旦形成之后，可作为一种继发性致病因素反过来作用于人体，进一步影响肺、脾、肾、三焦等脏腑的功能活动，影响水液代谢。如痰湿困脾，可致水湿不运；痰饮阻肺，可致宣降失职，水液不布；痰饮停滞下焦，可影响肾、膀胱的蒸化功能，从而进一步导致水液停蓄。因此，痰饮致病能影响人体水液的输布与排泄，使水液进一步停留于体内，加重水液代谢障碍。（3）易于蒙蔽心神：痰饮为浊物实邪，而心神性清净。故痰浊为病，随气上逆，尤易蒙蔽清窍，扰乱心神，使心神活动失常，出现头晕目眩、精神不振等症，或者痰浊上犯，与风、火相合，蒙蔽心窍，扰乱神明，以至出现神昏谵妄，或引起癫、狂、痫等疾病。（4）致病广泛，变幻多端：痰饮随气流行，内而五脏六腑，外而四肢百骸、肌肤腠理，无处不到，可停滞而引发多种疾病，因而其致病异常广泛。由于其致病面广，发病部位不一，且又易于兼邪致病，因而在临床上形成的病证繁多，症状表现非常复杂，故有“百病多由痰作祟”之说。痰饮停滞于体内，其病变可伤阳化寒，可郁而化火，可挟风、挟热，可化燥伤阴，可上犯清窍，可下注足膝，且病势缠绵，病程较长。因此，痰饮为病，还具有变幻多端，病证错综复杂的特点。根据痰饮所在部位和性质不同，痰饮病的临床表现也不完全一样。临床常见的痰饮病证有寒痰、热痰、燥痰、风痰、湿痰、痰饮、溢饮、支饮、悬饮等。身体痛重（C错）为湿邪的致病特点。重痛：指疼痛并伴有沉重的感觉，称为重痛。多见于头部、四肢及腰部，多因湿邪困遏气血所致。湿性重浊而黏腻，湿滞于经脉，则令人有沉重的感觉。如头沉而痛、四肢困重疼痛、腰重坠而痛者，均属湿证。癥积痞块（D错）为瘀血的致病特点。瘀血的致病特点：（1）疼痛：多为刺痛，痛处固定不移，拒按，夜间痛甚。（2）肿块：外伤肌肤局部，可见青紫肿胀；积于体内，久聚不散，则形成癥积，按之有痞块，固定不移。（3）出血：血色多呈紫暗色，并伴有血块。另外，临床望诊，往往还可见到面色黧黑、肌肤甲错、唇甲青紫、舌色紫暗或有瘀点、瘀斑，或舌下静脉曲张等表现。切诊则多见细涩、沉弦或结代等脉象。